颈外动脉是以下部位的动脉主干，除外
A. 颈前部
B. 脑的后2/5部分
C. 硬脑膜
D. 口腔颌面部
E. 颅顶

正确答案：B。脑的后2/5部分

解析：颈外动脉是颈前部、口腔颌面部、颅顶及硬脑膜等处的动脉主干。锁骨下动脉是供应颈部下份深面结构及脑的后2/5部分的动脉主干。掌握“颈内外动脉主要分支及分布”知识点。